最常见的输血反应是
A. 发热
B. 溶血
C. 休克
D. 荨麻疹
E. 呼吸困难

正确答案：A。发热

解析：输血不良反应中发热（A对）反应的发生率为2%～10%，是最为常见的输血反应；溶血（B错）反应是最严重的输血反应，但临床很少发生；过敏反应的发生率为3%，临床表现有休克（C错）、荨麻疹（D错）、呼吸困难（E错）。